酸蚀无法起到的作用有
A. 增大牙齿表面积
B. 机械清洁作用
C. 保护牙髓活力
D. 暴露清洁新鲜的釉质
E. A+B+D

正确答案：C。保护牙髓活力

解析：本题考查酸蚀的作用。酸蚀无法起到的作用有保护牙髓活力（C错，为本题的正确答案）。酸蚀具有机械清洁作用（B对），可溶解釉质表面的羟磷灰石，暴露清洁新鲜的釉质（D对），还可增加釉质的表面积（A对），从而增强复合树脂与釉质的粘结强度，并不能保护牙髓活力。